由母婴感染所致的先天性梅毒引起的桑葚牙，还可伴有
A. 牙面黄染
B. 牙髓钙化
C. 腭裂
D. 牙本质发育障碍
E. 先天牙缺失

正确答案：D。牙本质发育障碍

解析：由母婴感染所致的先天性梅毒引起的桑葚牙，病变呈桑葚状，同时可伴有牙本质发育障碍。掌握“氟牙症、先天性梅毒牙与牙本质形成缺陷”知识点。